医务人员在自己独处的时候，更要严格约束自己，这是因为
A. 慎独原则
B. 保密原则
C. 回避原则
D. 公平公正
E. 道德修养

正确答案：A。慎独原则

解析：“慎独”是指医务人员在单独工作无人监督时，仍能坚持医德信念，严格按照医德规范行事的修养方法及其所达到的境界。作为医德修养方法的慎独，其要点有三：一是坚持修养的高度自觉性，正确认识慎独修养的价值，不是把美德修养当作门面来装潢，也不是因为怕出丑遭人谴责而不得不慎独，而是自己自觉严格要求，自觉坚持提高，自觉保持在任何情况下做善事而不做恶事；二是坚持修养的高度彻底性，形成慎独精神，不忽视小事和细节，做到人前人后一个样，领导在和不在一个样，门诊病房一个样，白班、夜班一个样，也就是说，面对哪怕是极微小和隐蔽的不良诱惑，都能防微杜渐，“勿以恶小而为之”，面对哪怕是极琐碎但有益于患者健康之事，都能认真做好，“勿以善小而不为”；三是坚持修养的高度严谨性，打消一切侥幸心理，时时处处保持科学态度（A对）。